常与党参，白术配伍，用治脾胃虚寒腹痛的药物是
A. 干姜
B. 附子
C. 肉桂
D. 生姜
E. 吴茱萸

正确答案：A。干姜

解析：五种药除生姜均被列为温里药，生姜被列为发散风寒药。肉桂、附子、干姜性味均辛热，能温中散寒止痛，用治脾胃虚寒之脘腹冷痛、大便溏泄等。然干姜主入脾胃，长于温中散寒、健运脾阳，常与党参、白术等配伍（A对）；肉桂、附子味甘而大热，散寒止痛力强，善治脘腹冷痛甚者及寒湿痹痛证，二者又能补火助阳，用治肾阳虚证及脾肾阳虚证。生姜虽也能温里散寒，但作用不及干姜（D错）。吴茱萸归肝、脾、胃、肾经，散寒止痛，降逆止呕，助阳止泻。主入肝经，既散肝经之寒邪，又疏肝气之郁滞，为治肝寒气滞诸痛之主药（E错）。